灌注于心肺之脉的气是
A. 卫气
B. 营气
C. 元气
D. 宗气
E. 脏腑之气

正确答案：D。宗气

解析：血液的运行、心搏的力量与节律等皆与宗气有关。宗气充盛则脉搏和缓有力，节律一致（D对）；卫气行于外者分布在肌肤、皮毛、汗孔，行于内者分布在脏腑（A错）；营气运行于脉中，与血通行，内入五脏六腑，外达肢节（B错）；元气内而五脏六腑，外而肌肤孔窍，无处不至（C错）；脏腑之气分为脏气和腑气，脏气又进一步分为心气、肺气、脾气、肝气、肾气等（E错）。